女性，70岁。初戴全口义齿，主诉咀嚼费力，黏膜压痛且位置不确定，每天戴用时间越长症状越明显、且面部肌肉疲劳、进食时可出现后牙相撞声。最可能的原因是
A. 初戴不适应
B. 咬合不平衡
C. 义齿固位差
D. 义齿垂直距离过高
E. 基托压迫骨突黏膜

正确答案：D。义齿垂直距离过高

解析：垂直距离恢复得过大表现为面部下1/3距离增大，上下唇张开、勉强闭合上下唇时，颏唇沟变浅，颏部皮肤呈皱缩状，肌肉张力增加，容易出现肌肉疲劳感。可使牙槽嵴经常处于受压状态，久之可使牙槽嵴因受压而加速吸收。在说话和进食时可出现后牙相撞声，义齿容易出现脱位。掌握“全口义齿颌位关系及上（牙合）架”知识点。